6岁男孩，摔倒时左手撑地，即出现左肘部疼痛肿胀，桡动脉搏动减弱。局部检查明显压痛，有骨摩擦音，肘前方可扪及骨折断端。伤后有垂腕表现，可能是
A. 肌损伤
B. 正中神经损伤
C. 桡神经损伤
D. 尺神经损伤
E. 缺血性肌挛缩

正确答案：C。桡神经损伤

解析：患儿有摔倒左手撑地史，左肘部疼痛肿胀，局部明显压痛，有骨摩擦音（骨折特有体征），肘前方可扪及骨折断端，初步诊断为肱骨髁上骨折。有垂腕表现，提示可能为肱骨髁上骨折所致桡神经损伤（C对）。桡神经肘上损伤主要表现为伸腕、伸拇、伸指、前臂旋后障碍及手背桡侧（虎口区）感觉异常。典型的畸形是垂腕。肌损伤（A错）主要是由间接外力作用下使肌肉发生拉伤，表现为伤处疼痛、肿胀、压痛或痉挛，触之发硬。正中神经（B错）肘上损伤（P700）主要表现为拇对掌功能障碍、“猿手”畸形、手的桡侧半感觉障碍及拇指和示中指屈曲功能障碍。尺神经（D错）肘上损伤主要表现为环、小指“爪形手”畸形，手指内收、外展障碍（夹纸试验阳性）、Froment征阳性、手部尺侧半和尺侧一个半手指感觉障碍及环、小指末节屈曲功能障碍。缺血性肌挛缩（E错）是骨筋膜室综合征的晚期并发症，表现为爪形手。